疏水性环糊精衍生物
A. γ-环糊精
B. 甲基-β-环糊精
C. α-环糊精
D. 乙基-β-环糊精衍生物
E. β-环糊精

正确答案：D。乙基-β-环糊精衍生物